支配睫状肌的副交感神经低级中枢在
A. 动眼神经核
B. 动眼神经副核
C. 迷走神经背核
D. 下泌涎核
E. 无

正确答案：B。动眼神经副核

解析：支配睫状肌的副交感神经低级中枢在动眼神经副核（C对），此核发出副交感神经节前纤维加入动眼神经，入眼眶后止于睫状神经节，此节发出副交感神经节后纤维支配睫状肌和瞳孔括约肌的收缩。动眼神经核（A错）支配部分眼外肌运动。迷走神经背核（C错）支配颈部、胸部所有脏器和腹腔大部分脏器的平滑肌、心肌的活动和腺体的分泌。下泌涎核（D错）支配腮腺分泌。